一对准父母来妇幼保健院咨询有关孩子出生后进行新生儿疾病筛查的事情。医师的介绍正确的是：采血的时间、取血部位分别为
A. 生后24小时、头皮
B. 生后48小时、足跟
C. 生后48小时、头皮
D. 生后72小时、足跟
E. 生后72小时、头皮

正确答案：D。生后72小时、足跟

解析：本题考查新生儿疾病筛查相关内容。新生儿疾病筛查于新生儿出生72小时充分哺乳后在新生儿足跟进行（D对ABCE错）进行，以避免因哺乳不足无蛋白质负荷时苯丙酮尿症筛查的假阴性，出生72小时的采血可避开促甲状腺素的生理性增高，以减少甲状腺功能减退症筛查的假阳性。